可用于生产奶嘴的橡胶是
A. 乙丙橡胶
B. 硅橡胶
C. 丁橡胶
D. 丁苯橡胶
E. 氯丁橡胶

正确答案：B。硅橡胶

解析：本题考查可用于生产奶嘴的橡胶。可用于生产奶嘴的橡胶是硅橡胶（B对ACDE错）。